男性，12岁。误服有机磷农药1605（对硫磷）一口，急送医院就诊，当时测定胆碱酯酶活力为54%。患者急诊洗胃，洗胃液忌用
A. 肥皂水
B. 2%碳酸氢钠
C. 生理盐水
D. 冰水
E. 高锰酸钾

正确答案：E。高锰酸钾